类毒素的性质是
A. 有免疫原性，有毒性
B. 无免疫原性，无毒性
C. 有免疫原性，无毒性
D. 有毒性，无免疫原性
E. 有过敏原性，有毒性

正确答案：C。有免疫原性，无毒性